女性，26岁。多血质外观，向心性肥胖，痤疮，下腹及大腿外侧可见紫纹。血皮质醇明显增高。为进一步诊断病变部位，哪项检查最有意义
A. 尿17-羟测定
B. 血ACTH测定
C. 尿游离皮质醇测定
D. 小剂量地塞米松抑制试验
E. 垂体CT

正确答案：B。血ACTH测定

解析：患者多血质外观，向心性肥胖，痤疮，下腹及大腿外侧可见紫纹，有库欣综合征的典型症状，又血皮质醇明显增高可诊断为库欣综合征。库欣综合征的病因分类如下。1.依赖ACTH的库欣综合征包括：①库欣病；②异位ACTH综合征。2.不依赖ACTH的库欣综合征包括：①肾上腺皮质腺癌；②肾上腺皮质癌；③不依赖ACTH的双侧肾上腺小结节性增生④不依赖ACTH的双侧肾上腺大结节性增生。血ACTH测定有助于确定病因，从而有助于进一步诊断病变部位（B对）。尿17-羟皮质类固醇（A错）、尿游离皮质醇（C错）增高程度测定虽可以有助于病因诊断，但敏感性差且易受干扰，不是诊断病变部位最有意义的检查。肥胖症小剂量地塞米松抑制试验可被抑制，皮质醇增多症不能被抑制，小剂量地塞米松抑制试验用于肥胖症与皮质醇增多症的鉴别，对库欣综合征病因诊断无意义（D错）。垂体检查只可以检查病变部位是否在垂体，与血ACTH测定相比，不是最有意义的检查（E错）。